下列不属于G-蛋白偶联受体的是
A. M胆碱受体
B. γ-氨基丁酸受体
C. 阿片受体
D. α肾上腺素受体
E. 多巴胺受体

正确答案：B。γ-氨基丁酸受体

解析：本题考查G-蛋白偶联受体。γ-氨基丁酸受体（B错，为本题正确答案）是配体门控离子通道受体。G-蛋白偶联受体即与三磷酸鸟昔苷（GTP）结合调节蛋白（简称G-蛋白）相偶联的受体。如许多激素的受体、M胆碱受体（A对）、阿片受体（C对）、肾上腺素受体（D对）、多巴胺受体（E对）、5-HT受体、前列腺素受体以及一些多肽类受体等，通过G-蛋白偶联机制产生作用。